关于口腔流行病学的主要作用描述错误的是
A. 用于口腔疾病发展趋势的监测
B. 研究口腔疾病的病因和影响流行的因素
C. 研究口腔疾病治疗的新教材和新技术
D. 制定口腔卫生保健规划并评价其发展
E. 用于研究疾病预防措施并评价其效果

正确答案：C。研究口腔疾病治疗的新教材和新技术

解析：口腔流行病学作用：①描述人群口腔健康与疾病的分布状态。②研究口腔疾病的病因和影响流行的因素。③研究疾病预防措施并评价其效果。④监测口腔疾病流行趋势。⑤为制订口腔卫生保健规划提供依据。掌握“口腔流行病学概述及研究方法”知识点。